木瓜的道地产区是
A. 广东
B. 广西
C. 安徽
D. 新疆
E. 辽宁

正确答案：C。安徽

解析：本题考查的是木瓜的产地。木瓜的道地产区是安徽（C对）。木瓜：【产地】主产于安徽、湖北、四川、浙江等省。以安徽宣城的宣木瓜质量最好。广东（A错）是枇杷叶、阳春砂等的道地产区。广西（B错）是蛤蚧等的道地产区。新疆（D错）是阿魏等的道地产区。辽宁（E错）是细辛、人参、五味子等的道地产区。